长期使用可能诱发消化道溃疡、增加消化道出血风险的药物有
A. 阿托伐他汀
B. 地高辛
C. 阿司匹林
D. 双氯芬酸
E. 泼尼松龙

正确答案：C、D、E。阿司匹林；双氯芬酸；泼尼松龙

解析：本题考查药物的不良反应。长期使用可能诱发消化道溃疡、增加消化道出血风险的药物有阿司匹林（C对）、双氯芬酸（D对）、泼尼松龙（E对）。非选择性NSAID类药物可导致胃及十二指肠溃疡和出血、胃出血、胃穿孔，代表药有阿司匹林、双氯芬酸、尼美舒利等；阿托伐他汀（A错）的主要不良反应是肝毒性和肌毒性；中毒剂量的地高辛（B错）可以影响心肌收缩，加重心力衰竭。